职业病是由何种因素引起的
A. 加强对所在单位的卫生监督
B. 职业性有害因素
C. 有害的生产过程
D. 有害的劳动过程
E. 立即向当地职防机构报告

正确答案：B。职业性有害因素

解析：本题考查职业病的概念。职业病是指职业性有害因素（B对ACDE错）作用于人体的强度与时间超过一定限度，人体不能代偿其所造成的功能性或器质性病理改变，从而出现相应的临床征象，影响劳动能力。职业病的法定定义是，企业、事业单位和个体经济组织等用人单位的职业从事者在职业活动中，因接触粉尘、放射性物质和其他有毒、有害因素而引起的疾病。